男，55岁。胰头癌行胰十二指肠切除术后6天，发现整个右下肢肿胀。查体：右下肢皮温增高，股三角区深压痛，足背动脉搏动存在。错误的治疗措施是
A. 应用止血药物
B. 口服阿司匹林
C. 皮下注射低分子肝素
D. 卧床休息、抬高患肢
E. 静脉输注低分子右旋糖酐

正确答案：A。应用止血药物

解析：中年男性患者，胰头癌行胰十二指肠切除术后6天（手术后血液处于高凝状态；术后需卧床，导致下肢静脉血流缓慢，容易引起下肢深静脉血栓形成），发现整个右下肢肿胀（提示静脉回流障碍）。查体：右下肢皮温增高，股三角区深压痛（髂-股静脉血栓形成的典型临床表现），足背动脉搏动存在（提示动脉畅通）。综合该患者的病史及体查，诊断考虑髂-股静脉血栓形成。应用止血药物（A错，为本题正确答案）可促进凝血，加速血栓形成，加重梗阻，是错误的治疗措施。口服阿司匹林（B对）可防治血小板聚集；皮下注射低分子肝素（C对）可降低机体的血凝功能；卧床休息、抬高患肢（D对）有利于下肢血液及组织液经浅静脉及淋巴道回流；静脉输注低分子右旋糖酐（E对）可扩充血容量、降低血黏度。